不是由腹膜形成的结构有
A. 肝圆韧带
B. 肝胃韧带
C. 肝十二指肠韧带
D. 肝镰状韧带
E. 肝冠状韧带

正确答案：A。肝圆韧带

解析：肝镰状韧带（D对）是腹前壁上部和膈下面连于肝上面的双层腹膜结构，肝圆韧带（A错，为本题正确答案）是由胚胎时脐静脉闭锁后形成的遗迹，不是由腹膜形成，肝胃韧带（B对）是小网膜由肝门连于胃小弯的部分，为双层腹膜结构。肝十二指肠韧带（C对）是小网膜由肝门连于十二指肠上部之间的部分，同为双层腹膜结构。肝冠状韧带（E对）是由膈下面的壁腹膜返折至肝上面所形成的双层腹膜结构。